主要含有木脂素类化学成分的中药是
A. 丹参
B. 厚朴
C. 前胡
D. 秦皮
E. 千里光

正确答案：B。厚朴

解析：本题考查的是厚朴的化学成分。主要含有木脂素类化学成分的中药是厚朴（B对）。厚朴中主要化学成分为木脂素类化合物，包括厚朴酚以及和厚朴酚等，《中国药典》采用高效液相色谱法测定药材中厚朴酚与和厚朴酚含量，两者总含量不得少于2.0%。丹参（A错）的化学成分主要包括脂溶性成分和水溶性成分两大部分。脂溶性成分大多为共轭醌、酮类化合物。如丹参酮Ⅰ、丹参酮ⅡA、丹参酮ⅡB、隐丹参酮等。《中国药典》采用高效液相色谱法测定丹参中丹参酮类和丹酚酸B的含量，要求丹参酮ⅡA、隐丹参酮和丹参酮Ⅰ的总量不得少于0.25%，丹酚酸B不得少于3.0%。另外，水溶性成分则包括丹参素，丹参酸A、丹酚酸B，原儿茶酸，原儿茶醛等。前胡（C错）主要化学成分为多种类型的香豆素及其糖苷、三萜糖苷及甾体糖苷、挥发油等。一般以香豆素类成分作为前胡定量质量控制的指标。《中国药典》采用高效液相色谱法测定药材中白花前胡甲素和白花前胡乙素含量，其中白花前胡甲素含量不少于0.90%，白花前胡乙素不少于0.24%。秦皮（D错）的原植物主要有两种，即木犀科植物大叶白蜡树及白蜡树，大叶白蜡树皮中主要含七叶内酯（秦皮乙素）和七叶苷（秦皮甲素），而白蜡树皮中主要含白蜡素和七叶内酯以及白蜡树苷。《中国药典》采用高效液相色谱法并规定本品按干燥品计，含秦皮甲素、秦皮乙素的总量不得少于1.0%。千里光（E错）中所含有的生物碱主要为吡咯里西啶类生物碱，主要化学成分有千里光宁碱、千里光菲宁碱及痕量的阿多尼弗林碱等；同时含有黄酮苷等成分。《中国药典》以阿多尼弗林碱为指标成分进行限量测定，其中阿多尼弗林碱的含量不得过0.004%。